属于原核细胞型的一组微生物是
A. 酵母菌、淋球菌
B. 放线菌、破伤风梭菌
C. 链球菌、念珠菌
D. 隐球菌、结核分枝杆菌
E. 小孢子菌、大肠埃希菌

正确答案：B。放线菌、破伤风梭菌

解析：有细胞结构的微生物分为原核细胞型微生物和真核细胞型微生物，其中原核细胞型微生物无核仁核膜，细胞器不完善，包括细菌、支原体、衣原体、立克次体、螺旋体和放线菌等，因此放线菌和破伤风梭菌都属于原核细胞（B对），真核细胞型微生物细胞核分化程度高，有核膜和核仁，细胞器完整，真菌为此类微生物。淋球菌属于奈瑟菌属，结核分枝杆菌属于分支杆菌属，链球菌属于链球菌属，大肠埃希菌属于埃希菌属，均是细菌，为原核细胞型微生物。菌酵母菌（A错）、念珠菌（C错）、隐球菌（D错）、小孢子菌（E错）均是真菌，为真核细胞型微生物。